关于表面活性剂特性的正确表述有
A. 表面活性剂分子缔合形成胶束的最低浓度称为临界胶束浓度
B. 表面活性剂分子中亲水和亲油基团对油或水的综合亲合力称为亲水亲油衡值
C. 表面活性剂分子在水溶液中达到CMC后，一些难溶性药物在胶束溶液中溶解度显著增加，这种作用叫增溶
D. 当温度升高时非离子型表面活性剂的溶解度增加，超过某一温度时，溶解度急剧增大，这一温度称为Krafft点
E. 当温度升高到某一程度时，两性离子型表面活性剂的溶解度急剧下降并析出溶液出混浊，这一温度称为昙点

正确答案：A、B、C。表面活性剂分子缔合形成胶束的最低浓度称为临界胶束浓度；表面活性剂分子中亲水和亲油基团对油或水的综合亲合力称为亲水亲油衡值；表面活性剂分子在水溶液中达到CMC后，一些难溶性药物在胶束溶液中溶解度显著增加，这种作用叫增溶